复元活血汤的君药是
A. 栀子、蒲黄
B. 大黄、栀子
C. 大黄、柴胡
D. 青黛、栀子
E. 柴胡、当归

正确答案：C。大黄、柴胡

解析：复元活血汤的药物组成为柴胡、瓜蒌根、当归、红花、甘草、穿山甲、大黄、桃仁。方中重用酒制大黄，荡涤凝瘀败血，导瘀下行，推陈致新；柴胡疏肝行气，并可引诸药入肝经。两药合用，一升一降，以攻散胁下之瘀滞，共为君药（C对）。桃仁、红花活血祛瘀，消肿止痛；穿山甲破瘀通络，消肿散结，共为臣药。当归补血活血；瓜蒌根"续绝伤"，"消仆损瘀血"，既能入血分助诸药而消瘀散结，又可清热润燥，共为佐药。甘草缓急止痛，调和诸药，是为使药。大黄、桃仁酒制，及原方加酒煎服，乃增强活血通络之意。